反流性食管炎治疗作用最强的药物是
A. 法莫替丁
B. 奥美拉唑
C. 颠茄
D. 铝碳酸镁
E. 多潘立酮

正确答案：B。奥美拉唑

解析：对于胃食管返流病已出现食管炎的患者，效果最好的药物是质子泵抑制剂（PPI）奥美拉唑（B对）。法莫替丁（组胺H2受体拮抗剂）（A错）主要用于胃食管返流病轻、中症患者，不宜用于已并发食管炎的患者。颠茄（C错）常用来做镇痉及镇痛药。碳酸镁铝（D错）可中和胃酸保护黏膜从而缓解反流性食管炎，但不是作用最强的药物。多潘立酮（E错）具有较强的促胃运动作用，但对胃酸没有影响。